小儿呼吸系统最常见的疾病
A. 支气管哮喘
B. 急性支气管炎
C. 急性上呼吸道感染
D. 过敏性鼻炎
E. 急性支气管肺炎

正确答案：C。急性上呼吸道感染

解析：婴幼儿期呼吸道解剖结构、生理特点、免疫情况决定了小儿易患呼吸道感染。上呼吸道是指环状软骨以上的呼吸道，包括鼻、咽、喉，与外界相通，是最容易遭受病原体侵袭的部位，因此急性上呼吸道感染是小儿最常见的疾病（C对）。